舌下腺囊肿的内容物的性质为
A. 白色凝乳状物质
B. 豆腐渣样物质
C. 蛋清样黏稠液体
D. 灰白色角化物质
E. 淡黄色含胆固醇结晶液体

正确答案：C。蛋清样黏稠液体

解析：舌下腺囊肿穿刺可抽出蛋清样黏稠液体。掌握“舌下腺及唾液腺黏液囊肿”知识点。